全冠粘固后短期内出现咬合痛，其主要原因是
A. 牙髓充血
B. 牙冠松动
C. 牙周炎
D. 创伤（牙合）
E. 以上都不是

正确答案：D。创伤（牙合）

解析：本题考查全冠粘固后短期内出现咬合痛的原因。全冠粘固后短期内出现咬合痛，其主要原因是存在咬合高点、创伤（牙合）（D对）。病理性的牙髓充血（A错）实际上是牙髓的早期改变，大多由深龋引起，细菌或其代谢产物经牙本质小管缓慢而轻微刺激牙髓，使病损相对的牙髓组织呈现充血状态，其临床表现主要为牙本质过敏，患牙遇冷刺激可出现一过性的疼痛反应，刺激去除后疼痛随即消失，不会出现咬合痛。若全冠粘固后短期内出现疼痛是由于牙冠松动（B错），那么引起牙冠松动的原因主要是粘结不牢固，就不会引起咬合痛。牙周炎（C错）的主要临床是牙龈炎症、出现牙周袋、附着丧失以及牙槽骨吸收，不会造成咬合痛。创伤（牙合）即为全冠粘固后短期内出现咬合痛的主要原因（E错）。